以下属于筛查性智力测验的是
A. 韦氏学龄前儿童智力量表
B. 绘人测验
C. 贝利婴幼儿智力发育量表
D. 发育量表
E. 斯坦福-比内量表

正确答案：B。绘人测验

解析：本题考查神经心理发育的测评方法。绘人测验（B对）是一种能引起儿童兴趣的、简便易行的智力测验方法。韦氏学龄前儿童智力量表（A错）适用于2岁6个月～7岁3月幼儿的智力测量工具。贝利婴幼儿智力发育量表（C错）适用的年龄范围是两个月到30个月的婴儿。发育量表（D错）主要评价中枢神经系统的功能，识别神经肌肉或感觉系统是否有缺陷，发现存在的可以治疗的发育异常，对高危儿发现他们的行为随后的变化，对孤独症、发育迟缓具有诊断价值。斯坦福-比奈测验（E错）适用于评价2～18岁儿童青少年的一般智力水平及诊断智力低下。